氨基糖苷类抗生素的不良反应是
A. 再生障碍性贫血
B. 耳蜗听神经损伤
C. 肝毒性
D. 心脏毒性
E. 消化道反应

正确答案：B。耳蜗听神经损伤

解析：氨基糖苷类抗生素可在内耳外淋巴液内蓄积，可引起前庭功能障碍以及耳蜗神经损害（B对），前庭功能障碍主要表现为眩晕、恶心、呕吐、平衡失调，耳蜗神经损害表现为耳鸣、听力减退甚至耳聋等，用药过程中应密切观察，调整药物剂量。除此之外氨基糖苷类药物还可诱发药源性肾衰、过敏反应，其中药热、皮疹、血管神经性水肿较常见、神经肌肉麻痹以及面部、口唇发麻、周围神经炎等，无再生障碍性贫血（A错）、肝毒性（C错）、心脏毒性（D错）、消化道反应（E错）等。